按药品不良反应新分类方法，不能根据药理学作用预测，减少剂量不会改善症状的不良反应属于
A. A类反应（扩大反应）
B. D类反应（给药反应）
C. E类反应（撤药反应）
D. C类反应（化学反应）
E. H类反应（过敏反应）

正确答案：E。H类反应（过敏反应）

解析：本题考查药物不良反应的分类。不能根据药理学作用预测，减少剂量不会改善症状的不良反应属于H类反应（过敏反应）（E对）。药品不良反应新分类方法把药品不良反应分为9类，它们是A、B、C、D、E、F、G、H、U类。A类(扩大反应）（A错）：药物对人体呈剂量相关的反应，它可根据药物或赋形剂的药理学和作用模式来预知，停药或减量可以部分或完全改善。B类(bugs反应）：由促进某些微生物生长引起的不良反应，这类反应可以预测，它与A类反应的区别在于B类反应主要针对微生物，但应注意，药物致免疫抑制而产生的感染不属于B类反应，如抗生素引起的腹泻等。C类(化学反应）（D错）：该类反应取决于赋形物或药物的化学性质，化学刺激是其基本形式，这类反应的严重程度主要取决于药物浓度。D类(给药反应）（B错）：反应由给药方式引起，它不依赖于成分的化学物理性质。给药方式不同会出现不同的不良反应，改变给药方式，不良反应消失。如注射剂中的微粒引起的血管栓塞。E类(撤药反应）（C错）：它是生理依赖的表现，只发生在停药或剂量减少后，再次用药症状改善。F类(家族性反应）：仅发生在由遗传因子决定的代谢障碍敏感个体中的不良反应，此类反应必须与人体对某种药物代谢能力的正常差异而引起的不良反应相鉴别，如葡萄糖6-磷酸脱氢酶缺陷引起的镰状细胞性贫血是F类反应，而CYP2D6缺乏引起的反应则为A类反应。G类(基因毒性反应）：能引起人类基因损伤的不良反应，如致畸、致癌等。H类(过敏反应）：它们不是药理学可预测的，且与剂量无关。必须停药。如光敏反应等。U类(未分类反应）：指机制不明的反应，如药源性味觉障碍等。